若充填后上颌前牙牙齿咬物折裂，为冠根联合折，裂纹直达根尖，则应
A. 备牙，全冠修复
B. 使用氢氧化钙垫底充填
C. 根管治疗
D. 桩核冠修复
E. 拔除牙齿

正确答案：E。拔除牙齿

解析：充填修复后牙齿完全裂至髓室底，按照此情况只有拔除。掌握“牙折”知识点。